不是产气荚膜梭菌致病物质的是
A. 卵磷脂酶
B. 胶原酶
C. 透明质酸酶
D. 肠毒素
E. 内毒素

正确答案：E。内毒素

解析：产气荚膜梭菌能产生10余种外毒素，其中有些即为胞外酶，内毒素不是产气荚膜梭菌致病物质，其他几个选项都是正确的。掌握“厌氧芽胞梭菌”知识点。